男性，17岁，右上后牙3天来遇甜酸痛，平时无其它不适。查见14近中边缘嵴约小米大小透暗色区，建议充填用材料是
A. 聚羧酸锌水门汀
B. 复合树脂
C. 银汞合金
D. 磷酸锌水门汀
E. 玻璃离子水门汀

正确答案：B。复合树脂

解析：本题考查口腔材料的性能与选择、垫底与暂封材料。“到近中边缘嵴约小米大小透暗色区”且“3天来遇甜酸痛”提示患牙为中龋，应给予充填治疗。该部位充填材料不但要求强度，而且要求美观，因此首选复合树脂（B对）。